生物转化酶的基本特征为
A. 具有广泛底物特异性和立体选择性
B. 有结构酶和诱导酶之分
C. 某些酶具有多态性
D. 以上都是

正确答案：D。以上都是

解析：本题考查生物转化酶的基本特征。生物转化酶的基本特征有：①广泛的底物特异性：一类或一种酶可代谢几种外源化学物，而且还可代谢内源性化学物；②立体选择性：生物转化酶对某些手性外源化学物的生物转化具有立体选择性，即对一种对映体的生物转化率要快于另一对映体；③有结构酶和诱导酶之分；④某些酶具有多态性：其结构（即氨基酸序列）和活性不同（D对ABC错）。